艾滋病病毒感染者患隐球菌性脑膜炎首选
A. 灰黄霉素
B. 二性霉素
C. 酮康唑
D. 氟康唑
E. 制霉菌素

正确答案：D。氟康唑

解析：氟康唑是广谱抗真菌药，对隐球菌属、念珠菌属和球孢子菌属等均有作用。是治疗艾滋病患者隐球菌性脑膜炎的首选药，与氟胞嘧啶合用可增强疗效。掌握“氟康唑、利巴韦林及阿昔洛韦”知识点。